男，58岁。外出途中突然头痛眩晕，伴呕吐走路不稳前来急诊。查体BP180/105mmHg心率62次/分，双眼向右水平眼震，右手指鼻不准，右侧跟膝胫试验阳性。首先应采取的处理措施是
A. 快速静脉滴注地塞米松10mg
B. 利血平降血压
C. 降低颅内压
D. 肌注苯巴比妥钠预防癫痫
E. 若CT示出血量达到5ml时，手术治疗

正确答案：C。降低颅内压

解析：中老年男性患者， 活动中突发头痛眩晕，伴呕吐（提示颅内压增高可能）走路不稳，查体：BP180/105mmHg（正常值140/90mmHg），双眼向右水平眼震，右手指鼻不准，右侧跟膝胫试验阳性（小脑性共济失调表现）。高血压患者急性起病，且有颅内压增高及小脑性共济失调表现，考虑小脑出血，因小脑半球是控制同侧肢体的协调运动并维持正常的肌张力，故应为右小脑半球出血。患者处于脑出血急性期，应首先积极控制脑水肿，降低颅内压（C对），以防脑疝形成。不建议用激素减轻脑水肿（A错）。一般认为脑出血患者血压升高是机体为保证脑组织血供的血管自动调节反应，随着颅内压降低血压也会降低，故调整血压应以脱水降颅压为基础，尽量不用降压药（如利血平）（B错），防止因血压下降过快引起脑低灌注（P192）。脑出血恢复期可能出现癫痫等并发症，但抗癫痫治疗不是脑出血的首要治疗措施（D错）。小脑出血量达10ml以上才考虑手术治疗（E错）（P193）。